口腔黏膜色素痣属于口腔黏膜色素性病变之一，口腔黏膜痣最多见的是
A. 黏膜内痣
B. 皮内痣
C. 交界痣
D. 复合痣
E. 复杂痣

正确答案：A。黏膜内痣

解析：口腔黏膜色素痣属于口腔黏膜色素性病变之一。口腔黏膜痣以黏膜内痣最多，其次是普通蓝痣。掌握“口腔黏膜色素痣”知识点。